使淋巴细胞溶解，致淋巴细胞耗竭的药物是
A. 亚叶酸钙
B. 地塞米松
C. 昂丹司琼
D. 氟他米特
E. L-门冬酰胺酶

正确答案：B。地塞米松

解析：本题考查地塞米松的作用机制。使淋巴细胞溶解，致淋巴细胞耗竭的药物是地塞米松（B对）。糖皮质激素可使淋巴细胞溶解，以致淋巴结、脾及胸腺中淋巴细胞耗竭。大剂量应用甲氨蝶呤后，用亚叶酸钙（A错）解救，可减轻本品所致的黏膜损害和骨髓抑制。昂丹司琼（C错）能选择性地阻断中枢及迷走神经传入纤维5-HT₃受体，产生强大的镇吐作用。氟他米特（D错）即氟他胺，该药是一种非甾体的雄激素拮抗剂，适用于晚期前列腺癌患者。其作用机制为此药与雄激素竞争肿瘤部位的雄激素受体，组织细胞对雄激素的摄取，抑制雄激素与靶器官的结合。L-门冬酰胺酶（E错）为影响氨基酸供应、阻止蛋白质合成的药物。可降解血中门冬酰胺，使瘤细胞缺乏此氨基酸，不能合成蛋白质。